慢性痛风和痛风性肾病，为促进尿酸排泄，可选用
A. 别嘌醇
B. 秋水仙碱
C. 泼尼松龙
D. 苯溴马隆
E. 双氯芬酸

正确答案：D。苯溴马隆

解析：本题考查痛风治疗药。慢性痛风和痛风性肾病，为促进尿酸排泄，可选用苯溴马隆（D对）。别嘌醇（A错）是目前常用抑制尿酸生成的药物，是慢性痛风和痛风性肾病的首选药。秋水仙碱（B错）为痛风急性发作期首选药。波尼松龙（C错）用于痛风急性期发作的治疗，但停药后易复发。双氯芬酸（E错）不但能抑制前列腺素的合成，镇痛和抗炎，且能抑制尿酸盐结晶的吞噬，可作为急性期的基本用药，或在秋水仙碱疗效不好时作为替代药。